先天性肥厚性幽门狭窄所特有的临床表现是
A. 胃蠕动波
B. 呕吐
C. 黄疸
D. 右上腹肿块
E. 消瘦、脱水

正确答案：D。右上腹肿块

解析：先天性肥厚性幽门狭窄的临床表现有：1.呕吐（B错） 为本病的主要症状；2.胃蠕动波（A错） 常见，但非特有体征；3.右上腹肿块（D对）为本病特有体征；4.黄疸（C错） 约1%~2%的患儿伴有黄疸；5.消瘦、脱水（E错），反复呕吐，营养物质及水分摄入不足，非本病特有表现。